研末吹鼻，能引去湿热的药是
A. 常山
B. 明矾
C. 瓜蒂
D. 细辛
E. 冰片

正确答案：C。瓜蒂

解析：本题考查的是瓜蒂功效。研末吹鼻，能引去湿热的药是瓜蒂（C对）。瓜蒂：【功效】内服涌吐热痰、宿食；外用研末吹鼻，引去湿热。常山（A错）：【功效】涌吐痰饮，截疟。明矾（B错），即白矾。白矾：【功效】外用解毒杀虫，燥湿止痒；内服止血止泻，清热消痰。细辛（D错）：【功效】祛风散寒，通窍，止痛，温肺化饮。冰片（E错）：【功效】开窍醒神，清热止痛。